某一类Ig，分子量为970kD，在分子结构上无铰链区；在生物进化上出现最早，在个体发育中最早在B淋巴细胞膜上表达。在近期感染的病人血清中，该Ig水平升高是由于
A. 其产生最早，半衰期最长
B. 其产生最早，半衰期最短
C. 其产生最晚，半衰期最长
D. 其产生最晚，半衰期最短
E. 以上都不是的原因

正确答案：B。其产生最早，半衰期最短